三七凝胶贴膏剂处方组成：三七提取物2g、薄荷脑2g、樟脑3g、卡波姆24g、甘油7.7g、聚维酮（PVP）6g、明胶0.5g、三乙醇胺适量、氮酮和丙二醇适量、蒸馏水加至100g。其中用作透皮促进剂的是
A. PVP
B. 卡波姆
C. 三乙醇胺
D. 明胶
E. 丙二醇

正确答案：E。丙二醇

解析：本题考查的是三七凝胶贴膏剂。三七凝胶贴膏剂中用作透皮促进剂的是丙二醇（E对）。三七凝胶贴膏剂：【注解】本品为类白色片状凝胶贴膏剂。三七凝胶贴膏剂是一个亲水凝胶型透皮系统。方中卡波姆-934（B错）、PVP（A错）、明胶（D错）合用为黏合剂；甘油为保湿剂。三乙醇胺（C错）用以调节pH使卡波姆成为稠厚的凝胶状，可增加膏体的赋形性和持黏力；氮酮和丙二醇为双相透皮促进剂；凝胶贴膏剂中因膏体基质成分复杂，需按要求顺序分别处理、溶解与混合各组分才能制得均匀、具较好黏附性与赋形性的膏体。